胸神经说法何者有误？
A. 第7~12对胸神经前支主干行于腹内斜肌和腹横肌之间
B. 前支都不参加组成丛
C. 第10胸神经分布相当于脐平面
D. 第7~12对胸神经前支还支配腹前外侧肌群
E. 前支多数不参加组成丛

正确答案：B。前支都不参加组成丛

解析：第7-11肋间神经及肋下神经在相应肋间隙内向前下方走行，出肋间隙进人腹壁后，续行于腹横肌和腹内斜肌之间（A对）。胸神经前支除第1胸神经前支加入臂丛外，其余不参加组成丛（B错，为本题正确选项）。T10相当于脐平面（C对）。下5对肋间神经发出的肌支分布于腹前外侧壁肌群（D对）。